腹痛1天诊断为卵巢瘤蒂扭转，错误的处理是
A. 一经确诊即应手术
B. 术时应在蒂根部下方钳夹
C. 抢救休克同时尽快手术
D. 切除肿瘤前不能松解肿瘤蒂后钳夹
E. 行肿瘤剜除术，避免术中将肿瘤弄破，取下肿瘤应切开检查并送病理

正确答案：E。行肿瘤剜除术，避免术中将肿瘤弄破，取下肿瘤应切开检查并送病理

解析：卵巢肿瘤蒂扭转的典型症状是体位改变后突然发生一侧下腹剧痛，常伴恶心、呕吐甚至休克，治疗原则是一经确诊即应手术（A对）切除，术时应先在蒂根部下方钳夹（B对）后，再将肿瘤和扭转的瘤蒂一并切除。切除肿瘤前不能松解肿瘤蒂后钳夹（D对），以防蒂部血栓脱落栓塞至身体的重要器官或组织。还应避免术中将肿瘤弄破，污染腹腔。取下的肿瘤应切开检查，并送病理学检查，依据术中快速切片结果，进一步决定手术方式和范围。若合并休克，应抢救休克同时尽快手术（C对）。肿瘤剜除术（第二版实用妇产科学P704）（E错，为本题正确答案）适用于成熟畸胎瘤的年轻患者，尽量保留正常卵巢组织，以维持患者正常内分泌水平，但若合并蒂扭转则选用手术切除。